在烹调蔬菜时，下列哪种做法易使水溶性维生素遭破坏
A. 尽量保持植株完整
B. 先洗后切
C. 急火快炒
D. 适量加些醋
E. 下锅前用冷水浸泡，开水烫，挤去汁液

正确答案：E。下锅前用冷水浸泡，开水烫，挤去汁液